坏死性唾液腺化生的好发部位为
A. 唇腺
B. 磨牙后腺
C. 舌下腺
D. 腭腺
E. 腮腺

正确答案：D。腭腺

解析：坏死性唾液腺化生多发生于腭部，也见于唇、颊、及磨牙后腺，腭部多在软硬腭交界处，可单侧或双侧。掌握“坏死性唾液腺化生与舍格伦综合征”知识点。